支气管哮喘的临床表现是
A. 长期、反复咳嗽、咳痰
B. 反复咳嗽、咳痰，喘息，并伴有哮鸣音
C. 咳嗽、咳痰，伴长期午后低热，消瘦，盗汗
D. 发作性带哮鸣音的呼气性呼吸困难
E. 夜间熟睡后突然憋醒，伴咳嗽、咳痰

正确答案：D。发作性带哮鸣音的呼气性呼吸困难

解析：支气管哮喘的临床表现是发作性带哮鸣音的呼气性呼吸困难（D对）。长期、反复咳嗽、咳痰（A错）为慢性支气管炎的表现。反复咳嗽、咳痰，喘息，并伴有哮鸣音（B错）为慢性支气管炎喘息型的表现。咳嗽、咳痰，伴长期午后低热，消瘦，盗汗（C错）为肺结核表现。夜间熟睡后突然憋醒，伴咳嗽、咳痰（E错）为左心衰竭的表现。